某男，6岁。口干多饮，纳呆食少，面黄肌瘦，四肢倦怠，精神不振，体虚多汗、大便干结，舌红少苔，脉细。诊断为厌食，证属脾胃虚弱、胃阴不足。宜选用中成药是
A. 儿宝颗粒
B. 枳术丸
C. 启脾丸
D. 健胃消食片
E. 保和丸

正确答案：A。儿宝颗粒

解析：本题考查的是厌食的辨证论治。某男，6岁。口干多饮，纳呆食少，面黄肌瘦，四肢倦怠，精神不振，体虚多汗、大便干结，舌红少苔，脉细。诊断为厌食，证属脾胃虚弱、胃阴不足。宜选用中成药是儿宝颗粒（A对）。厌食，是指脾胃受纳运化功能失常所致的疾病，以较长时间的厌恶进食，食量减少为临床特征。西医学的厌食症可参考此内容辨证论治。（一）脾失健运证：【中成药应用】常用中成药有健儿消食口服液、复方消食茶。（二）脾胃气虚证：【中成药应用】常用中成药有参苓白术散、启脾丸（C错）。（三）脾胃阴虚证：【中成药应用】常用中成药有儿宝颗粒。健胃消食片（D错）为积滞脾虚夹积证的中成药应用。积滞脾虚夹积证：【中成药应用】常用中成药有健胃消食片、小儿胃宝丸。保和丸（E错）为积滞乳食内积证的中成药应用。积滞乳食内积证：【中成药应用】常用中成药有保和丸（水丸）、小儿消食片、小儿化食丸、大山楂丸、四磨汤口服液。中成药应用为枳术丸（B错）的病证，2022年考试指南未明确说明。